1990年，某城市有麻疹暴发流行。经调查发现，此时期有大量的流动儿童迁入。从人群易感性角度考虑，这主要是因为
A. 免疫人口减少
B. 免疫力自然消退
C. 易感人群迁入
D. 隐性感染减少
E. 儿童比例增加

正确答案：C。易感人群迁入